喙突软骨出现在发育的
A. 第四个月
B. 第五个月
C. 第六个月
D. 第七个月
E. 第八个月

正确答案：A。第四个月

解析：喙突软骨出现在发育的第4个月，位于喙突的前缘和顶端。掌握“唾液腺与颌骨的发育”知识点。